下列各项，可致人群对某种传染病学易感性增高的是
A. 该传染病学流行过后
B. 人群中一般抵抗力的提高
C. 人群中自动免疫的推广
D. 病原体的变异
E. 抗生素的广泛应用

正确答案：D。病原体的变异

解析：病原体的变异会使人群对某种传染病学易感性增高（D对）。该传染病学流行过后（A错）、人群中一般抵抗力的提高（B错）、人群中自动免疫的推广（C错）、抗生素的广泛应用（E错）均会使人群对该传染病学易感性降低。